附睾管的延续
A. 输精管
B. 射精管
C. 精索
D. 生精小管
E. 男性尿道

正确答案：A。输精管

解析：输精管（A对）是附睾管的直接延续。